男性，34岁。有多年消化性溃疡病史，近半年来发生瘢痕性幽门梗阻，在出现的临床特点中哪项不符合实际情况
A. 呕吐量大，多发生于傍晚
B. 呕吐物中含有食物和胆汁
C. 呕吐物中有酸臭味和宿食
D. 有胃型和胃蠕动波
E. 消瘦，脱水，低氯低钾性碱中毒

正确答案：B。呕吐物中含有食物和胆汁

解析：瘢痕性幽门梗阻指由于幽门、幽门管或十二指肠溃疡反复发作形成的瘢痕狭窄，其主要表现为腹痛和反复呕吐，呕吐多发生在下午或傍晚，呕吐量大，一次可达1000～2000ml（七版外科学P430）（A对），吐后自觉胃部饱胀改善。幽门梗阻可引起胃排空障碍，使食物蓄积在胃内，胆汁亦不能经梗阻的幽门反流入胃，故呕吐物多为宿食，有酸臭味（C对），不含有胆汁（B错，为本题正确答案）。幽门梗阻时上腹膨隆，梗阻近端扩张，可出现胃的轮廓（胃型）；若该部位伴有蠕动增强，可看到蠕动波（D对）。幽门梗阻患者由于呕吐丢失大量胃液（盐酸），可引起低氯性碱中毒；碱中毒后，细胞内钾离子和氢离子交换（H⁺出胞K⁺入胞）增加，可导致细胞外液低钾，综上幽门梗阻可出现低钾低氯性碱中毒。此外，大量呕吐，使消化液丢失可引起脱水；营养物质摄入不足，可引起消瘦（E对）。